我国酸雨的形成主要是由于
A. 燃烧石油
B. 烧煤
C. 森林失火过多
D. 硫酸厂排出废气过多
E. 硝酸厂排出废气过多

正确答案：B。烧煤

解析：本题考查酸雨的形成原因。酸雨是因大气污染所引起的，是大气中的酸性物质混合物形成的一种酸性降雨。我国酸雨的形成主要是由于烧煤（B对ACDE错），煤的组成结构主要是碳和氢，它还含有一定量的硫、氮、氧和其他元素。在燃烧过程中，煤会释放出含有硫和氮的气体，这些气体可以在大气中形成酸性气体，与大气中的水蒸气结合形成酸雨。